能引火归元的药物是
A. 肉桂
B. 附子
C. 干姜
D. 细辛
E. 丁香

正确答案：A。肉桂

解析：肉桂的功效是补火助阳，散寒止痛，温经通脉，引火归元。引火归元，顾名思义，即引离源浮越之火，使之向下归于本源且引火归源的实质为阴盛于下，格阳于上，即真寒假热证。本品大热入肝肾，能使因下元虚衰所致上浮之虚阳回归故里（A对）。附子的功效是回阳救逆，补火助阳，散寒止痛（B错）。干姜的功效是温中散寒，回阳通脉，温肺化饮（C错）。细辛的功效是解表散寒，祛风止痛，通窍，温肺化饮（D错）丁香的功效是温中降逆，散寒止痛，温肾助阳（E错）